香附配高良姜除温中散寒、疏肝理气外，又善
A. 止泻
B. 止咳
C. 止血
D. 止带
E. 止痛

正确答案：E。止痛

解析：本题考查的是香附的配伍。香附配高良姜除温中散寒、疏肝理气外，又善止痛（E对）。香附：【配伍】香附配高良姜：香附辛平，功善疏肝理气止痛；高良姜辛热，功善散寒止痛、温中止呕。两药相配，既温中散寒，又疏肝理气，且善止痛，治寒凝气滞、肝气犯胃之胃脘胀痛效佳。赤石脂：【功效】涩肠止泻（A错），止血（C错），止带（D错）；外用收湿敛疮生肌。榧子：【功效】杀虫，消积，润肠通便，润肺止咳（B错）。